关于嵌体的适应证，下列错误的是
A. （牙合）面严重磨损需咬合重建
B. 邻（牙合）洞上要放置支托
C. 青少年恒牙
D. 邻面接触点已破坏的牙体缺损
E. 成人恒牙牙体缺损

正确答案：C。青少年恒牙

解析：本题考查嵌体的适应证。关于嵌体的适应证错误的是青少年恒牙（C错，为本题正确答案）。一般来说，牙体缺损经牙体预备后，当剩余牙体组织可以耐受功能状态下的各向力而不致折裂，并能为嵌体提供足够固位形时（E对），则为嵌体修复的适应证，包括（牙合）面严重磨损需咬合重建（A对）、邻（牙合）洞上要放置支托（B对）以及邻面接触点已破坏的牙体缺损（D对）。但嵌体修复也有其临床注意事项和禁忌症，如青少年恒牙由于牙体组织薄弱不能提供较强固位力且牙体组织和牙槽骨还处于发育状态，故不适宜类似嵌体修复、全冠修复等修复手段。